不汇入奇静脉的静脉是
A. 右肋间后静脉
B. 胸廓内静脉
C. 食管静脉
D. 支气管静脉
E. 半奇静脉

正确答案：B。胸廓内静脉

解析：右肋间后静脉（A对）、食管静脉（C对）、支气管静脉（D对）、半奇静脉（E对）均为汇入奇静脉的静脉。胸廓内静脉（B错，为本题正确答案）汇入头臂静脉。